婴儿期要注意预防的主要疾病是
A. 寒冷综合征
B. 传染病
C. 感染性疾病
D. 风湿热
E. 近视眼

正确答案：C。感染性疾病

解析：婴儿出生5～6月后，来自母体的被动免疫已告结束，自身免疫能力虽有一定程度增长，但是仍然比较低下，易患感染性疾病，需按计划免疫程序接受基础免疫。传染病包含于感染性疾病的范畴内，婴儿除易患麻疹等传染性疾病，也容易患鹅口疮、肺炎等其他病原微生物引起的非传染性感染性疾病，故选择感染性疾病更为合适（B错C对）。寒冷综合征（A错）为新生儿期要注意预防的疾病。风湿热（D错）是学龄前期要注意预防的疾病。近视眼（E错）为学龄期要注意预防的疾病。